下列疾病出现咯血时，最常表现为持续痰中带血的疾病是
A. 心力衰竭
B. 肺血栓栓塞症
C. 肺炎
D. 肺癌
E. 支气管扩张

正确答案：D。肺癌

解析：肺癌时，气管周围肿瘤侵犯小血管常表现为持续痰中带血（D对）。心力衰竭时，支气管黏膜淤血，可有咯血，但是相对于肺癌，咳血症状少见（A错）。肺血栓栓塞症咯血常见，但痰中带血少见（B错）。肺炎痰中带血少见（C错）。支气管扩张常有大量反复咯血而非痰中带血（E错）。